戴全口义齿出现咬舌现象，需磨改
A. 上后牙舌尖舌斜面和下后牙舌尖颊斜面
B. 上后牙舌尖颊斜面和下后牙舌尖颊斜面
C. 上后牙颊尖颊斜面和下后牙颊尖颊斜面
D. 上后牙颊尖舌斜面和下后牙颊尖颊斜面
E. 上后牙颊尖舌斜面和下后牙舌尖颊斜面

正确答案：A。上后牙舌尖舌斜面和下后牙舌尖颊斜面

解析：咬颊、咬舌：由于后牙缺失时间过久，两颊部向内凹陷，或舌体变大而造成咬颊或咬舌现象，经过戴用一段时间后，常可自行改善。必要时可加厚颊侧基托，将颊部组织推向外侧。如果由于后牙排列覆盖过小，出现咬颊或咬舌时，可磨改上颌后牙颊尖舌侧斜面和下后牙颊尖的颊侧斜面，加大覆盖，解决咬颊现象。咬舌，可磨改上颌后牙舌尖舌侧斜面和下后牙舌尖颊侧斜面。掌握“全口义齿戴入后问题及处理”知识点。